被称为“粉瘤”的是
A. 皮样囊肿
B. 皮脂腺囊肿
C. 表皮样囊肿
D. 甲状舌管囊肿
E. 始基囊肿

正确答案：B。皮脂腺囊肿

解析：本题考查皮脂腺、皮样或表皮样囊肿。皮脂腺囊肿（B对）中医称“粉瘤”。